欲对某社区居民的健康状况进行调查研究，计划按居民的门牌号每隔5户抽1户，然后在选中的这户随机选择1名居民作为调查对象，这种选择方法为
A. 单纯随机抽样+分层抽样
B. 系统抽样+单纯随机抽样
C. 系统抽样+整群抽样
D. 整群抽样+系统抽样
E. 分层抽样+整群抽样

正确答案：B。系统抽样+单纯随机抽样